在社会药店，对审核、监督医师处方，管理处方药调配、销售或供应过程负责任的人员是
A. 执业药师
B. 药店经理
C. 值班经理
D. 药店营业员
E. 坐堂医师

正确答案：A。执业药师